新生儿，诊断为右侧完全性唇、腭裂。如伴发鼻畸形，应在何时进行手术
A. 出生后3～6个月
B. 出生后6～12个月
C. 出生后12～18个月
D. 患儿13岁时
E. 患者成长至24岁以后

正确答案：D。患儿13岁时

解析：本题考查鼻畸形矫治术的时间。多数学者认为婴幼儿期施行鼻畸形矫治术，会过多剥离鼻翼软骨而损伤其软骨膜，而影响到鼻翼软骨的正常发育，导致成年后出现难以矫正的鼻翼不对称畸形，而应推迟到13岁以后（D对）。因此出生后3～6个月（A错）、出生后6～12个月（B错）、出生后12～18个月（C错）都不宜进行手术。若待患者成长至24岁以后（E错），此时发育已经停止，鼻翼软骨已成形，手术效果不会很理想。